下列各项，心尖区触及舒张期震颤的是
A. 室间隔缺损
B. 动脉导管未闭
C. 二尖瓣狭窄
D. 二尖瓣关闭不全
E. 主动脉瓣狭窄

正确答案：C。二尖瓣狭窄

解析：二尖瓣狭窄（C对）的典型杂音为心尖区舒张中晚期低调的隆隆样杂音,呈递增型，局限，左侧卧位明显，运动或用力呼气可使其增强，常伴舒张期震颤。室间隔缺损（P287）（A错）为胸骨左缘第3～4肋间Ⅳ～Ⅵ级全收缩期杂音；动脉导管未闭（P288）（B错）的突出体征为胸骨左缘第二肋间及左锁骨下方的连续性机械样杂音；二尖瓣关闭不全（P305）（D错）的典型杂音为心尖区全收缩期吹风样杂音；主动脉瓣狭窄（P308）（E错）为胸骨右缘1～2肋间粗糙而响亮的收缩期射流性杂音,这四种疾病均不会在心尖区触及舒张期震颤。